下列哪个行业接触二异氰酸甲苯酯的机会最大
A. 电池制造
B. 印染
C. 塑料生产
D. 制鞋行业

正确答案：C。塑料生产

解析：本题考查二异氰酸甲苯酯的接触机会。二异氰酸甲苯酯，简称TDI，主要用于制造聚氨酯树脂及其泡沫塑料（C对ABD错）。在使用和制造TDI，尤其是蒸熘、配料、发泡、喷涂、浇铸及烧割操作时，可接触到较高浓度TDI，因此塑料生产行业有极大的概率接触到二异氰酸甲苯酯。